诱发DIC最常见的病因为
A. 恶性肿瘤
B. 手术及外伤
C. 革兰阴性细菌感染
D. 产科意外
E. 代谢性酸中毒

正确答案：C。革兰阴性细菌感染

解析：DIC（弥散性血管内凝血）的病因包括①严重感染最常见，尤其是革兰阴性细菌感染（C对）；②其次是恶性肿瘤（A错）；③羊水栓塞、子宫破裂等产科意外（D错）；④大面积烧伤，发生在脑、前列腺、胰腺等器官的手术及外伤（B错）；⑤严重中毒或免疫反应；⑥其他，如代谢性酸中毒（E错）、重症肝炎、系统性红斑狼疮等，较少见。